配对设计差值的符号秩和检验，编秩时，遇有差值绝对值相等。
A. 符号相同，必须取平均秩次
B. 符号相同，仍按顺序编秩
C. 符号不同，仍按顺序编秩
D. 不考虑符号，按顺序编秩
E. 可舍去不计

正确答案：B。符号相同，仍按顺序编秩